治寒积便秘，常以大黄配
A. 巴豆
B. 甘遂
C. 干姜
D. 芒硝
E. 芫花

正确答案：A、C。巴豆；干姜

解析：本题考查的是大黄的配伍。治寒积便秘，常以大黄配巴豆（A对）、干姜（C对）。大黄：【配伍】大黄配芒硝（D错）：大黄苦寒，功能泻下攻积、清热泻火、解毒；芒硝咸寒，功能泻下、软坚、清热。两药相配，既善泻下攻积，又善润软燥屎，还善清热泻火，治实热积滞、大便燥结、坚硬难下效佳。大黄配巴豆、干姜：大黄苦寒，功善泻热通便、攻积导滞；巴豆辛热，功善峻下冷积；干姜辛热，功善温中散寒。三药相配，巴豆得大黄，其泻下之力变缓和而持久；大黄得巴豆，其寒性可去；再加温中散寒之干姜，以助散寒之力。故善治寒积便秘。甘遂（B错）：【主治病证】（1）身面浮肿，大腹水肿，胸胁停饮。（2）风痰癫痫。（3）痈肿疮毒。芫花（E错）：【主治病证】（1）身面浮肿，大腹水肿，胸胁停饮。（2）寒痰咳喘。（3）头疮，白秃，顽癣，冻疮。